健康促进的核心策略是
A. 增加赋权
B. 部门协调
C. 社会动员
D. 宣传倡导
E. 鼓动传播

正确答案：C。社会动员

解析：健康促进是促使人们维护和提高他们自身健康的过程，是协调人类与环境的战略，它规定个人与社会对健康各自所负的责任。健康促进要运用倡导、赋权、协调三个基本策略，实现其目标，但从健康促进的定义可以看出，健康促进要求调动社会、政治和经济的广泛力量，改变影响人们健康的社会和物质环境条件，从而促进人们维护和提高他们自身健康的过程，因此，社会动员是其最基本也是最核心的策略（C对）。